关于诊断方法的叙述，下列哪项是正确的
A. 评价某种试验方法的可靠性指标主要包括特异度和灵敏度
B. 误诊率又称假阴性率
C. 正确诊断指数＝真实性＋可靠性－1
D. 灵敏度是指实际有病而按该诊断标准被正确地判为有病的百分比
E. 特异度是指实际无病而按该标准被判为有病的百分比

正确答案：D。灵敏度是指实际有病而按该诊断标准被正确地判为有病的百分比

解析：本题考查诊断方法的相关内容。灵敏度是指实际患病且被筛检试验标准判断为阳性的百分比（D对）。特异度是指实际无病且被筛检试验标准判断为阴性的百分比（E错）。评价某种试验方法的可靠性指标主要包括符合率、kappa值等（A错）。误诊率又称假阳性率（B错），即实际无病，但被筛检试验判断为阳性的百分比。正确指数＝（灵敏度＋特异度）－1（C错）。